治疗肺炎喘嗽的肺脾气虚证
A. 人参五味子汤
B. 华盖散
C. 参附龙牡救逆汤
D. 桑白皮汤
E. 桑菊饮

正确答案：A。人参五味子汤

解析：肺炎喘嗽的肺脾气虚证可见低热起伏不定，面白少华，动则汗出，咳嗽无力，纳差便溏，神疲乏力，舌质偏淡，舌苔薄白，脉细无力，治宜补肺健脾，益气化痰，方用人参五味子汤加减（A对）。华盖散功能辛温宣肺，化痰止咳，用于肺炎喘嗽之风寒闭肺证（B错）。参附龙牡救逆汤功能温补心阳，救逆固脱，用于肺炎喘嗽之心阳虚衰证（C错）。桑白皮汤功能清肺降气，化痰止嗽，用于顿咳之痉咳期（D错）。桑菊饮功能疏风清热，宣肺止咳，用于风热咳嗽（E错）。